血磷通常是指
A. 血浆中的无机磷
B. 红细胞中所含的磷
C. 血浆磷脂中所含的磷
D. 血浆中磷脂及无机磷酸盐所含磷的总和
E. 红细胞和血浆磷脂中所含磷的总和

正确答案：A。血浆中的无机磷

解析：血液中的磷以有机磷和无机磷两种形式存在。有机磷酸酯和磷脂存在于血细胞和血浆中，含量大。血磷通常是指血浆中的无机磷（A对），血浆无机磷酸盐的80% -85%以HPO42－式存在。